成年患者，输血100ml后，突然寒战高热，恶心呕吐，头痛心悸，剧烈腰痛，血压下降等，可诊断为
A. 发热反应
B. 过敏反应
C. 细菌污染反应
D. 溶血反应
E. 循环超负荷

正确答案：D。溶血反应

解析：成年患者，输血100ml后，突发寒战、高热，恶心、呕吐，头痛、心悸，剧烈腰痛，血压下降等，可诊断为溶血反应（D对）。溶血反应典型的症状为病人输入少量血型不合的血后，突发寒战、高热、腰背酸痛、头痛、血压下降、休克等症状，随后出现血红蛋白尿和溶血性黄疸。需注意：剧烈腰背疼痛合并血压下降一般提示发生溶血反应。发热反应（A错）血压多无变化，一般也不出现腰背酸痛。过敏反应（B错）表现为皮肤局限性或全身性瘙痒或荨麻疹。细菌污染反应（C错）也会出现寒战、高热、恶心、呕吐、血压下降等表现，但发生率不高，且一般不会出现剧烈腰痛。循环超负荷（E错）是由于输血速度过快、过量而引起，常见于心功能低下、老年、幼儿及低蛋白血症病人，表现为输血中或输血后突发心率加快、呼吸急促、发绀或咳血性泡沫痰，肺内可闻及大量湿啰音。